小儿咳嗽变异性哮喘的诊断依据是
A. 临床有明显感染征象
B. 用支气管扩张剂可使咳嗽发作缓解
C. 低热三周以上
D. 以往有呛咳病史
E. 镇静剂可缓解病情

正确答案：B。用支气管扩张剂可使咳嗽发作缓解

解析：用支气管扩张剂可使咳嗽发作缓解（B对），且临床上没有感染征象（A错）是小儿咳嗽变异性哮喘的基本诊断依据。低热三周以上（C错）应考虑肺结核可能性。以往有呛咳病史（D错）的原因很多，本题中并没有排除其他原因的条件，故不能选。哮喘危重状态下，作为治疗手段，镇静剂使患者平静，减轻氧气的消耗和需求（E错），但不是咳嗽变异性哮喘的诊断标准。